国家实行预防接种制度的对象是
A. 儿童
B. 在校学生
C. 未成年人
D. 成年人
E. 全体社会公民

正确答案：A。儿童

解析：国家实行预防接种制度的对象是儿童。国家对儿童实行预防接种证制度2016年4月国务院修订后的《疫苗流通和预防接种管理条例》规定，在儿童出生后一个月内，其监护人应当到儿童居住地承担预防接种工作的接种单位为其办理预防接种证（A对）。